胸大肌可使臂
A. 内收
B. 外展
C. 旋外
D. 后伸
E. 环转

正确答案：A。内收

解析：胸大肌可使臂内收（A对）、旋内及前屈。